正常人的血浆渗透压约为
A. 200mmol/L
B. 250mmol/L
C. 300mmoL/L
D. 350mmol/L
E. 400mmol/L

正确答案：C。300mmoL/L